（牙合）创伤对牙周病的主要作用是
A. 导致假性牙周袋的形成
B. 改变炎症的扩散途径
C. 导致牙周袋的形成
D. 加速牙槽骨的水平丧失
E. 加重牙龈的炎症程度

正确答案：B。改变炎症的扩散途径

解析：本题考查（牙合）创伤与牙周炎的关系。（牙合）创伤对牙周病的主要作用是改变炎症的扩散途径（B对）。（牙合）创伤在一定程度上能影响炎症扩散至牙周支持组织的途径。单纯、短期的（牙合）创伤不会导致牙周袋的形成（AC错），也不会加重牙龈的炎症程度（E错）。当长期的（牙合）创伤伴随严重的牙周炎或明显的局部刺激时，它会加重牙槽骨的垂直性骨吸收（D错）。